患者，男，45岁。咳嗽痰多，咳声重浊，咳痰色白清稀有泡沫，每于晨间咳痰尤甚，因痰而咳，痰出而咳缓，舌苔白腻。用药宜首选
A. 前胡、瓜蒌
B. 瓜蒌、半夏
C. 半夏、橘皮
D. 橘皮、甘草
E. 甘草、天南星

正确答案：C。半夏、橘皮

解析：咳嗽痰多，咳声重浊，痰白清稀，每于晨间咳痰尤甚，因痰而咳，痰出而咳缓，属于湿痰咳嗽，半夏、橘皮燥湿化痰，痰消则咳自止（C对）。前胡（A错）的功效是降气化痰，散风清热。瓜蒌（B错）的功效是清热涤痰，宽胸散结，润肠通便，主要用于治疗热痰证。甘草（D错）的功效是补脾益气，清热解毒，祛痰止咳，缓急止痛，调和诸药。天南星（E错）的功效是燥湿化痰，祛风止痉，散结消肿，多用于治疗寒湿顽痰。